打结是重要的手术基本功，皮肤、黏膜的缝合，为拆线时牵引方便，应至少余留
A. 1mm以上
B. 2mm以上
C. 3mm以上
D. 4mm以上
E. 5mm以上

正确答案：E。5mm以上

解析：本题考查打结的相关内容。打结是重要的手术基本功，皮肤、黏膜的缝合，为拆线时牵引方便，应至少余留5mm以上（E对）。线头留得较长时，剪线比较容易；留短线时则技术要求稍高，为了提高准确性，可将剪刀微张，以剪刀之一侧紧贴结扎线向下滑动至结扣处，然后向外上方稍加翻转剪断，如此，可使留下之线头在1mm左右。组织内结扎线头所留长度一般为1mm左右（A错），但对较大的血管及大块肌肉竖等以粗线结扎时，为防止滑脱可增加到3～4mm（CD错）。缝合线若为肠线，因易滑脱，其余留线头长度也应为3～4mm（B错）。